治疗小儿肺炎喘嗽风热闭肺证，应首选
A. 桑菊饮
B. 银翘散
C. 抱龙丸
D. 安神丸
E. 麻杏石甘汤

正确答案：E。麻杏石甘汤

解析：肺炎喘嗽以发热、咳嗽、痰壅、气急、鼻煽为主要症状，风热之邪侵犯肺卫，肺失宣降，清肃之令不行，致肺被邪束，闭郁不宣，则致肺炎喘嗽，用麻杏石甘汤（E对 ），症见发热恶风，头痛有汗，鼻塞流浊涕，咳嗽，气促，咯吐黄痰，咽喉红肿，喉核红肿，纳呆，舌质红，苔薄黄，脉浮数，指纹浮紫。桑菊饮善于治疗风热犯肺之咳嗽，症见咳嗽不爽，痰黄黏稠（A错）。抱龙丸主治脾胃不和，风热痰内蕴所致的腹泻，症见食乳不化、恶心呕吐、大便稀、有不消化食物（C错）。安神丸益气养血，安神宁心，适用于失眠，头昏，耳鸣，心悸，健忘（D错）。